说明抗休克治疗时血容量仍不足的是
A. 尿量少，CVP很高
B. 尿量少，CVP较低
C. 尿量多，CVP很低
D. 尿量多，CVP正常
E. 尿量多，CVP偏高

正确答案：B。尿量少，CVP较低

解析：补充血容量是纠正休克引起的组织低灌注和缺氧的关键，而监测指标为尿量和中心静脉压等。尿量反应肾血流灌注，尿量少通常是早期休克和休克复苏不完全的表现；CVP即中心静脉压，反映的是全身血容量与右心功能之间的关系，CVP较低说明血容量不足。综上，尿量少，CVP较低（B对）说明抗休克治疗时血容量仍不足。尿量少，CVP很高（A错）提示可能出现急性肾衰竭。尿量多，CVP很低（C错）可见于创伤危重病人复苏时使用高渗溶液者或涉及神经垂体的颅脑损伤出现尿崩者。尿量多，CVP正常（D错）提示休克已纠正，血容量补足。尿量多，CVP偏高（E错）提示充血性心力衰竭可能。